男性，18岁，少语、少动1年，近半年来不知主动洗澡更衣，对亲友冷淡，常闭门独坐，喃喃白语，时无故发笑。最可能的诊断是
A. 神经症
B. 躁狂症
C. 精神分裂症
D. 抑郁症
E. 反应性精神障碍

正确答案：C。精神分裂症